脱疽湿热毒盛的治疗方剂宜选用
A. 五神汤
B. 五味消毒饮
C. 四妙汤
D. 四妙勇安汤
E. 四妙散

正确答案：D。四妙勇安汤

解析：四妙勇安汤功用清热解毒，活血止痛，主治热毒炽盛之脱疽（D对）。五神汤功效清热解毒，分利湿热，主治委中毒，焮痛色赤，属湿热凝结者（A错）。五味消毒饮功效清热解毒，消散疔疮，主治火毒结聚之疔疮（B错）。四妙汤功能托里排毒，主治痈疽发背，肠痈，乳痈，无名肿毒，焮红疼痛，憎寒壮热，状若伤寒者（C错）。四妙散主治遍身疥癞（E错）。